化学致癌的促进阶段，较为正确的一种描述是
A. 促进启动细胞的表型在组织水平表达的过程；促进剂必须在引发剂前给予才发挥作用；促进作用必须持续作用，有可测定的阈剂量。
B. 促进启动细胞的表型在组织水平表达的过程；促进剂必须在引发剂后给予才发挥作用；促进作用必须持续作用，无测定的阈剂量。
C. 促进启动细胞的表型在组织水平表达的过程；促进剂必须在引发剂前给予才发挥作用；促进作用必须持续作用，无可测定的阈剂量。
D. 促进启动细胞的表型在组织水平表达的过程；促进剂必须在引发剂后给予才发挥作用；促进作用必须持续作用，有可测定的阈剂量。
E. 促进启动细胞的表型在组织水平表达的过程；促进剂必须与引发剂同时给予才发挥作用；无可测定的阈剂量。

正确答案：D。促进启动细胞的表型在组织水平表达的过程；促进剂必须在引发剂后给予才发挥作用；促进作用必须持续作用，有可测定的阈剂量。

解析：本题考查化学致癌的过程。促进阶段为化学致癌作用的第二阶段，化学致癌的促进阶段是促进启动细胞的表型在组织水平表达的过程；促进剂必须在引发剂后给予才发挥作用；促进作用必须持续作用，有可测定的阈剂量（D对ABCE错）。